瘀血多见
A. 胀痛
B. 重痛
C. 刺痛
D. 隐痛
E. 掣痛

正确答案：C。刺痛

解析：本题考查的是疼痛的性质特点及临床意义。瘀血多见刺痛（C对）。疼痛的性质特点及临床意义：（1）胀痛（A错）：指疼痛伴有胀满或胀闷。多为气滞所致，在很多部位都可以出现，以胸脘、腹部为最多。如胃脘胀痛，则为中焦寒凝气滞；胸胁胀痛，则为肝郁气滞等。头部胀痛，则多见于肝阳上亢或肝火上炎的病证。（2）重痛（B错）：指疼痛并伴有沉重的感觉，称为重痛。多见于头部、四肢及腰部，多因湿邪困遏气血所致。湿性重浊而黏腻，湿滞于经脉，则令人有沉重的感觉。如头沉而痛、四肢困重疼痛、腰重坠而痛者，均属湿证。（3）刺痛：指疼痛有如针刺的感觉，称为刺痛。是瘀血疼痛的特点之一，以胸胁、少腹、小腹、胃脘部出现为多。（4）绞痛：指痛如绞割一样，疼痛剧烈难忍的感觉，称为绞痛。多因有形实邪闭阻气机而成，如心血瘀阻引起的真心痛，蛔虫上窜引起的脘腹痛，石淋引起的腰痛或小腹痛等，往往都具有绞痛的性质。（5）灼痛：指痛有灼热感而喜凉的感觉，称为灼痛。常见于两肋或胃脘部。多由于火邪窜络，或阴虚阳热亢盛所致。（6）冷痛：指痛有冷感而喜暖的感觉，称为冷痛。常见于头、腰、脘腹部的疼痛，多因寒邪阻络或为阳气不足，脏腑、经络不得温养而成。（7）隐痛（D错）：指疼痛并不剧烈，可以忍耐，却绵绵不休，持续时间较长的感觉，称为隐痛。一般多是气血不足，阴寒内生，气血运行滞涩而成。多见于头、脘、腹、腰部的虚性疼痛。（8）掣痛（E错）：指抽掣或牵引而痛的感觉，称为掣痛。多由筋脉失养或阻滞不通所致，因肝主筋，故掣痛多与肝病有关。